白血病的牙龈病损不可能出现的临床表现是
A. 牙龈肿胀常为局部性
B. 组织松软脆弱或中等硬度，表面光亮
C. 颜色暗红发绀或苍白
D. 牙龈炎症明显
E. 牙龈肿胀可覆盖部分牙面

正确答案：A。牙龈肿胀常为局部性

解析：本题考查白血病的牙龈病损。白血病的牙龈病损不可能出现的临床表现是牙龈肿胀常为局部性（A错，为本题的正确答案）。白血病的牙龈病损可波及龈乳头、龈缘和附着龈。主要表现为：①牙龈肿大，颜色暗红发绀或苍白（C对），组织松软脆弱或中等硬度，表面光亮（B对）。牙龈肿胀常为全口性，且可覆盖部分牙面（E对）。由于牙龈肿胀、菌斑堆积，牙龈一般有明显的炎症（D对）。②由于牙龈中大量幼稚血细胞浸润积聚，可造成末梢血管栓塞，局部组织对感染的抵抗力降低，使龈缘处组织坏死、溃疡和假膜形成，状如坏死性溃疡性龈炎，严重者坏死范围广泛，有口臭。③牙龈有明显的出血倾向，龈缘常有渗血，且不易止住，牙龈和口腔黏膜上可见出血点或淤斑。患者常因牙龈肿胀、出血不止或坏死疼痛而首先到口腔科就诊。及时检查血象有助于诊断。④严重的患者还可出现口腔黏膜的坏死或剧烈的牙痛（牙髓腔内有大量幼稚血细胞浸润引起）、发热、局部淋巴结肿大以及疲乏、贫血等症状。